右归丸除温补肾阳外，还具有的功用是
A. 填精补血
B. 补益脾胃
C. 理气健脾
D. 散寒止痛
E. 纳气平喘

正确答案：A。填精补血

解析：本题考查右归丸的功效，属记忆内容。右归丸主治，肾阳不足，命门火衰证。熟地、山茱萸、枸杞子、山药滋阴益肾，养肝补脾，填精补髓。功效为温补肾阳，填精补血，所以填精补血为正确选项（A对）。